实证常见于外感病的哪个阶段
A. 末期
B. 初期
C. 各个阶段
D. 初期或中期
E. 以上均非

正确答案：D。初期或中期

解析：实证常见于外感六淫和疠气所致的外感病证的初期和中期（D对ABCE错）。